在使用注意方面宜从小量开始，缓缓增加，以免阳升风动，头晕目赤的药物是
A. 冬虫夏草
B. 石斛
C. 鳖甲
D. 白术
E. 鹿茸

正确答案：E。鹿茸

解析：鹿茸服用宜从小量开始，缓缓增加，不可骤用大量，以免阳升风动，头晕目赤，或伤阴动血（E对）。冬虫夏草（A错）有表邪者不宜使用。石斛（B错）能敛邪，故温热病不宜早用，又能助湿，若湿温热尚未化燥伤津者忌服。鳖甲（C错）脾胃虚寒者忌服，孕妇慎用。白术（D错）炒用可增强补气健脾止泻作用。